28岁，右口角疔疮2天，根深坚硬，形如钉丁状，焮热红肿，疼痛，张口不便，伴恶寒发热，舌苔腻，脉滑数。治疗应首选
A. 五味消毒饮
B. 清暑汤
C. 防风通圣散
D. 普济消毒饮
E. 银翘散

正确答案：A。五味消毒饮

解析：该患者右口角疔疮，根深坚硬，形如钉丁状，焮热红肿，疼痛，张口不便，伴恶寒发热，当属颜面部疔疮，合参舌苔腻，脉滑数，为热毒蕴结证，以清热解毒为法，治以五味消毒饮、黄连解毒汤加减（A对）。清暑汤可用于疖之暑热浸淫证（B错）。防风通圣散可用于瘾疹之胃肠湿热（C错）。普济消毒饮可用于锁喉痈之痰热蕴结证（D错）。银翘散可用于颈痈之风热痰毒证（E错）。